关于T₃和T₄，下列叙述正确的是
A. T₃的血浆蛋白结合率高于T₄
B. T₃起效快，作用强
C. T₃起效慢，作用持久
D. T₃起效快，作用持久
E. T₃起效慢，作用弱

正确答案：B。T₃起效快，作用强